硫酸铝为常用的混凝剂，其特点为
A. 腐蚀性小，对水质无不良影响，水温低时形成絮状体较松散
B. 腐蚀性大，对水质无不良影响，效果一般
C. 腐蚀性小，对水质有些影响，水温低时形成絮状体较紧密
D. 腐蚀性小，使用不方便，对水质无不良影响
E. 腐蚀性小，水温低时形成絮状体较紧密，效果好

正确答案：A。腐蚀性小，对水质无不良影响，水温低时形成絮状体较松散

解析：本题考查硫酸铝的特点。铝盐是常用的混凝剂，硫酸铝的优点是：腐蚀性小，使用方便，混凝效果好，且对水质无不良影响。缺点是：水温低时，絮凝体形成慢且松散（A对BCDE错），效果不如铁盐。